治疗崩漏的三法是
A. 塞流、澄源、求因
B. 补肾、益脾、调肝
C. 补肾、益脾、化痰
D. 塞流、澄源、复旧
E. 塞流、止血、求因

正确答案：D。塞流、澄源、复旧

解析：崩漏的治疗应根据病情的缓急轻重、出血的久暂，采用“急则治其标，缓则治其本”的原则，塞流即止血、澄源即辩证求因以治本、复旧即调理善后（D对）。澄源与求因重复（A错）；调补肝脾肾（B错）或祛邪化痰（C错）仅为辩证求因以治本的内容；塞流与止血同义（E错）。